大气污染状况监测中，下列除了哪项都是点源监测的布点方法
A. 捕捉烟波采样
B. 烟波下方采样
C. 棋盘式布点
D. 四周布点
E. 扇形布点

正确答案：C。棋盘式布点

解析：本题考查点源监测的布点方法。对大气污染状况监测时，点源监测布点方式包括：1.四周布点（D对）：以污染源为中心，划8个方位，在不同距离的同心圆上布点，并在更远的距离或其他方位设置对照点；2.扇形布点（E对）：在污染源常年或季节主导方向的下风侧，划3～5个方位，在不同距离上设置采样点，在上风侧适当距离设置对照点；3.捕捉烟波布点（AB对）：随烟波变动的方向，在烟波下方不同距离采样，同时在上风侧适当距离设置对照点。此方法采样点不固定，随烟波方向变动，可以每半天确定一次烟波方向。棋盘式布点（C错，为本题正确答案）不是点源监测的布点方法。